男性，50岁。右侧腹股沟斜疝嵌顿8小时入院。急症手术中发现嵌顿入疝囊的回肠有约50%坏死，行坏死回肠切除肠吻合术。对伤口进行彻底清洗后，无明显炎症表现。疝处理应首选
A. 单纯疝囊高位结扎术
B. Ferguson法疝修补术
C. Bassini法疝修补术
D. Halste法疝修补术
E. 无张力疝修补术

正确答案：A。单纯疝囊高位结扎术

解析：中年男性患者，右侧斜疝嵌顿8小时，急症手术中见嵌顿的回肠约有50%坏死（提示已进展为绞窄性疝），行坏死回肠切除肠吻合术后，疝处理应首选单纯疝囊高位结扎术（A对）。该患者因肠管绞窄坏死而有局部严重感染，一般仅行单纯疝囊高位结扎术，以避免因感染而致疝修补失败。Ferguson法疝修补术（B错）、Bassini法疝修补术（C错）、Halsted法疝修补术（D错）和无张力疝修补术（E错）适用于无绞窄的腹股沟疝。